男，32岁。肛门肿胀伴畏寒、发热4周。症状反复发作并逐渐加重，伴有排尿不适，肛门旁出现局部红肿疼痛，继之破溃流出脓液。确保疗效的关键步骤是
A. 瘘管切开，形成敞开的创面
B. 抗感染治疗后手术
C. 1：5000高锰酸钾溶液坐浴
D. 明确破溃外口和内口的位置
E. 首先充分扩肛

正确答案：D。明确破溃外口和内口的位置

解析：青壮年男性患者（肛瘘好发人群），肛门肿胀伴畏寒、发热4周（全身感染症状）。症状反复发作并逐渐加重（症状反复发作为肛瘘主要临床特点），伴有排尿不适，肛门旁出现局部红肿疼痛，继之破溃流出脓液（脓肿破溃）。根据患者病史、体查，可考虑诊断为肛瘘。确保疗效的关键步骤是明确破溃外口和内口的位置（D对），并完全切除之，以防复发。瘘管切开，形成敞开的创面（A错）虽有利于愈合，但不是最关键的。抗感染治疗后手术（B错）和1︰5000高锰酸钾溶液坐浴（C错）属于非手术治疗，只适用于脓肿初期以及手术前准备时。肛瘘术后需要充分扩肛（E错），防止肛门狭窄。